一病人左颞下颌关节在开口、咀嚼时疼痛，无自发痛，检查发现开口中度受限、开口型偏左侧，左髁突后方明显压痛，未见红肿。其诊断应该是
A. 左翼外肌痉挛
B. 左关节盘后区损伤
C. 左关节囊附丽松弛
D. 左髁突破坏
E. 左关节盘穿孔

正确答案：B。左关节盘后区损伤

解析：本题考查左关节盘后区损伤的临床表现。关节盘后区损伤多由于各种原因造成开口过大所导致，表现为开口受限和髁状突后方压痛，但不红肿；在急性期，患者可在开口、咀嚼时疼痛，但无自发痛，开口常偏向患侧，根据题意描述，此患者的诊断应是左关节盘后区损伤（B对）。左翼外肌痉挛（A错）表现为在开口、咀嚼时疼痛，但检查时压痛点位于翼外肌相应面部，相当于关穴处和上颌结节后上方而非本题中的左髁突后方。左关节囊附丽松弛（C错）的患者表现为开口过大呈半脱位，与题意不符。若存在左髁突破坏（D错），不可能没有自发痛。左关节盘穿孔（E错）表现为开闭口、前伸，侧方运动的任何阶段有多声破碎音，亦与题意不符。